乙肝疫苗的初种年龄应该在
A. 出生
B. 1个月
C. 2个月
D. 3个月
E. 4个月

正确答案：A。出生

解析：掌握“儿童保健原则”知识点。